临床上把患者对自己精神状态的认识和判断能力称为
A. 洞察力
B. 理解力
C. 自制力
D. 自知力
E. 想象力

正确答案：D。自知力

解析：患者对自己精神状态的认识和判断能力是自知力（D对）。洞察力（A错）是指深入事物或问题的能力。理解力（B错）指对某个事物或事情的认识、认知、转变过程的能力。自制力（C错）是指人们能够自觉地控制自己的情绪和行动。想象力（E错）是人在已有形象的基础上，在头脑中创造出新形象的能力。